临床诊治工作的基本道德原则不包括的内容
A. 及时原则
B. 准确原则
C. 主体诱导原则
D. 自主择优原则
E. 有效原则

正确答案：C。主体诱导原则